麦门冬汤中配伍粳米、大枣、甘草的意义是
A. 佐金平木
B. 培土生金
C. 扶土抑木
D. 滋水涵木
E. 益火补土

正确答案：B。培土生金

解析：麦门冬汤方中重用麦门冬，以养阴生津，滋液润燥，半夏降逆下气，化痰和胃，人参健脾补气，甘草、粳米、大枣甘润性平，合人参和中滋液，培土生金；诸药合用，使肺胃阴复，逆气得降，中土健运，诸症自愈（B对）